关于急性牙髓炎的病理变化不正确的是
A. 成牙本质细胞层完好无损
B. 具有浆液性炎症的特征
C. 可见血管扩张充血，通透性增加
D. 液体成分渗出，组织水肿
E. 水肿液集聚于微血管周围和结缔组织间

正确答案：A。成牙本质细胞层完好无损

解析：急性牙髓炎的病理变化：由龋所致的早期病变局限在龋洞下方，具有浆液性炎症的特征，可见血管扩张充血，通透性增加，液体成分渗出，组织水肿，水肿液集聚于微血管周围和结缔组织间，沿着血管壁有白细胞游出和纤维蛋白渗出，成牙本质细胞层有变性破坏。掌握“急、慢性牙髓炎”知识点。